通过稳定肥大细胞膜而预防各种哮喘发作的是
A. 沙丁胺醇
B. 扎鲁司特
C. 噻托溴铵
D. 齐留通
E. 色甘酸钠

正确答案：E。色甘酸钠

解析：本题考查影响白三烯的平喘药色甘酸钠。色甘酸钠（E对）能够通过稳定肥大细胞膜而预防多种哮喘的发作；沙丁胺醇（A错）通过激动β₂受体使支气管平滑肌舒张，缓解轻、中度急性哮喘症状；扎鲁司特（B错）通过阻断白三烯受体，缓解支气管的应激性，防治哮喘；噻托溴铵（C错）为M胆碱受体阻断剂，能够松弛支气管平滑肌，缓解哮喘；齐留通（D错）为N-羟基脲类5-脂氧酶抑制剂。